正确描述颈外动脉的是
A. 全程行于颈内动脉外侧
B. 行经腮腺深面
C. 在颧弓处分为颞浅动脉和上颌动脉
D. 分布于甲状腺上、下部
E. 上颌动脉为其分支

正确答案：E。上颌动脉为其分支

解析：颈外动脉初居颈内动脉的前内侧（A错），后经其前方转至外侧。上行穿腮腺（B错）至下颌颈处（C错）分为颞浅动脉和上颌动脉两条终支。分布于甲状腺上部（D错）。上颌动脉为其分支（E对）。